促红细胞生成素的产生部位主要在
A. 肝
B. 肾
C. 脾
D. 骨髓
E. 血液

正确答案：B。肾

解析：促红细胞生成素（EPO）的产生部位主要是肾（B对），是由肾皮质肾小管周围的间质细胞（如成纤维细胞、内皮细胞）产生。肝脏（A错）也能产生少许EPO，但其是血小板生成素（TPO）的主要产生部位。脾（C错）和骨髓（D错）不能产生EPO。血液（E错）存有一定量的EPO，但本身不能产生EPO。